细胞内液约占体重多少
A. 0.2
B. 0.3
C. 0.4
D. 0.5
E. 0.6

正确答案：C。0.4